使微粒Zeta电位降低的电解质
A. 助悬剂
B. 稳定剂
C. 润湿剂
D. 反絮凝剂
E. 絮凝剂

正确答案：E。絮凝剂

解析：本题考查混悬剂。混悬剂中如果加入适量的电解质，可使ζ-电位降低到一定程度，即微粒间的排斥力稍低于吸引力，此时微粒成疏松的絮状聚集体，经振摇又可恢复成均匀的混悬剂，这个现象叫絮凝，所加入的电解质称为絮凝剂（E对）。助悬剂（A错）是指能增加混悬剂中分散介质的黏度，降低药物微粒的沉降速度或增加微粒亲水性的附加剂。稳定剂（B错）是在混悬剂中起润湿、助悬、絮凝或反絮凝作用的附加剂。润湿剂（C错）是指能增加疏水性药物微粒被水润湿能力的附加剂。反絮凝剂（D错）是指能使混悬剂产生反絮凝作用的附加剂。